下列符合临终关怀伦理要求的做法是
A. 优先考虑临终患者家属的权益
B. 尽力满足临终患者的生活需求
C. 帮助临终患者抗拒死亡
D. 满足临终患者结束生命的要求
E. 建议临终患者选择安乐死

正确答案：B。尽力满足临终患者的生活需求

解析：本题考查临终关怀。临终关怀伦理的基本特点服务对象多元化、服务内容全面化和服务形式多样化、本土化化，应尽力满足临终患者的生活需求（B对）。